环境污染物在靶部位的蓄积量
A. 在经历六个生物半减期后，趋于降低
B. 在经历六个生物半减期后，趋于稳定
C. 只要暴露期足够长，就会达到对机体产生有害效益的水平
D. 只要生物半减期足够长，就会达到对机体产生有害效应的水平
E. 只要暴露频度低，就会达到对机体产生有害效应的水平

正确答案：B。在经历六个生物半减期后，趋于稳定

解析：本题考查环境污染物在靶部位的蓄积量。从理论上讲，化学污染物进入机体经历六个生物半减期后，在体内最大可能蓄积量趋于稳定（B对ACDE错），此后，摄入量与排出量趋于平衡。